一个地区通过首次高血压普查，可计算当地的
A. 高血压发病率
B. 高血压患病率
C. 高血压死亡率
D. 高血压续发率

正确答案：B。高血压患病率

解析：本题考查普查的指标。普查属于现况调查，现况调查所得到的频率指标一般为特定时间内调查群体的患病率，因此通过高血压普查，可计算当地的高血压患病率（B对ACD错）。